原植物属于唇形科的
A. 金钱草
B. 穿心莲
C. 益母草
D. 荆芥
E. 香薷

正确答案：C、D、E。益母草；荆芥；香薷

解析：本题考查的是常见全草类中药的来源。原植物属于唇形科的益母草（C对）、荆芥（D对）或香薷（E对）。益母草：【来源】为唇形科植物益母草的新鲜或干燥地上部分。荆芥：【来源】为唇形科植物荆芥的干燥地上部分。香薷：【来源】为唇形科植物石香薷或江香薷的干燥地上部分。金钱草（A错）：【来源】为报春花科植物过路黄的干燥全草。穿心莲（B错）：【来源】为爵床科植物穿心莲的干燥地上部分。